哪项不是环境流行病学暴露测量的好指标
A. 环境介质中某种污染物的浓度
B. 血液、尿液等生物材料中污染物的含量
C. 血液、尿液等生物材料中污染物的代谢产物的含量
D. 骨骼中重金属的含量
E. 血红蛋白加合物的含量

正确答案：D。骨骼中重金属的含量

解析：本题考查环境流行病学暴露测量的相关内容。某一有害环境因素的过程称之为环境暴露水平是指人群接触某一有害环境因素的浓度或剂量。在暴露测量中，被检测的剂量有三种：外暴露剂量（A对）、内暴露剂量（BC对）和生物有效剂量（E对）。骨骼中重金属的含量（D错，为本题正确答案）不是环境流行病学暴露测量的好指标。